不是慢性地方性硒中毒的特异性表现的是
A. 毛发脱落
B. 指甲脱落
C. 皮肤湿疹
D. 脚趾干性坏疽
E. 运动障碍

正确答案：D。脚趾干性坏疽

解析：本题考查慢性地方性硒中毒的特异性表现。长期摄入含硒较高食物，可使头发、胡须、眉毛（A对）、指（趾）甲逐渐脱落（C对）；皮肤湿疹样改变（B对）、发痒、刺痛，或出现感觉迟钝、麻木等末梢神经炎症状，导致运动障碍（E对）。脚趾干性坏疽（D错，为本题正确答案）慢性地方性砷中毒的特异性表现症状。